抗体分子的抗原结合部位是
A. Fc段
B. Fab段
C. 绞链区
D. 轻链C末端
E. 重链C末端

正确答案：B。Fab段